C-3位为氯原子，亲脂性强，口服吸收好的药物是
A. 头孢氨苄
B. 头孢克洛
C. 头孢呋辛
D. 硫酸头孢匹罗
E. 头孢曲松

正确答案：B。头孢克洛

解析：本题考查头孢菌素类抗菌药。头孢克洛（B对）是头孢氨苄的C-3位甲基被氯原子取代得到的可口服的半合成头孢菌素。头孢氨苄（A错）C-3位为甲基。头孢呋辛（C错）C-3位为氨基甲酸酯。头孢匹罗（D错）含有季铵基团。头孢曲松（E错）的C-3位为杂环。